化学毒物在消化道吸收的主要部位是
A. 食管
B. 胃
C. 小肠
D. 大肠

正确答案：C。小肠

解析：本题考查化学毒物在消化道吸收的主要部位。化学毒物在消化道吸收的主要部位是小肠（C对ABD错），其次是胃。